女，55岁。咳嗽，咳脓血痰伴高热2天。糖尿病病史8年。胸部X线片示双肺多发团片状阴影，有空洞形成。查体：背部可见多个疖肿，双肺少量湿性啰音，心腹未见异常。最可能的诊断为
A. 大肠埃希菌肺炎
B. 军团菌肺炎
C. 血源性肺脓肿
D. 肺炎克雷伯杆菌肺炎
E. 肺结核

正确答案：C。血源性肺脓肿

解析：患者为中老年女性，咳嗽、咳脓血痰伴高热，胸部X线片示双肺多发团片状阴影，有空洞形成（为肺脓肿的典型胸片改变），且患有糖尿病病史8年，背部可见多个疖肿（血源性肺脓肿常见的诱因），根据其临床表现和辅助检查，患者考虑诊断为为皮肤疖所致的脓毒血症，菌栓血行播散到肺，引起的肺部小血管炎症、坏死而形成的肺脓肿，故患者最可能的诊断是血源性肺脓肿（C对）。大肠埃希菌肺炎（A错）多见于老年衰弱患者，原有各种慢性基础疾病危重病患者、气管插管、长期使用皮质激素及其他免疫抑制剂治疗者，主要表现为寒战、发热、咳嗽、咳痰、胸痛、发绀及呼吸困难等，与皮肤感染等关系不大。军团菌肺炎（B错）主要表现为高热、肌痛、相对缓脉，X线表现为肺下叶斑片浸润、无空洞。肺炎克雷伯杆菌肺炎（D错）主要表现为寒战、高热、咳砖红色胶冻样痰，X线表现为肺叶或肺段实变、蜂窝状脓肿、叶间隙下坠。肺结核（P65）（E错）主要表现为咳嗽、咳痰、低热、盗汗等结核毒血症的表现，X线示病变多发生在上叶的尖后段，下叶的背段和后基底段，呈多态性改变。